属于非典型抗精神病药物的是
A. 卡马西平
B. 硫酸锂
C. 氟西汀
D. 利培酮
E. 阿普唑仑

正确答案：D。利培酮

解析：利培酮（D对）是第二代抗精神病药（非典型抗精神病药），其主要对5-HT和DA受体双重阻断，在治疗剂量下不产生锥体外系反应副作用和血清催乳素升高的一类抗精神病药。卡马西平（A错）（P125）是广谱抗癫痫药，也可治疗神经痛、尿崩症，还具有很强的抗抑郁作用。碳酸锂（B错）主要用于抗躁狂，还可用于治疗躁狂抑郁症。氟西汀（C错）是一种选择性5-羟色胺再摄取抑制剂（SSRI）型的抗抑郁药。阿普唑仑（E错）是苯二氮䓬类，主要用于焦虑症、失眠症、癫痫和惊厥。